氯丙嗪的不良反应是
A. 躯体依赖性
B. 静坐不能
C. 眼内压下降
D. 血压升高
E. 乳腺萎缩

正确答案：B。静坐不能

解析：本题考查药物不良反应。氯丙嗪的不良反应是静坐不能（B对）。氯丙嗪的不良反应：锥体外系，其表现形式是：①药源性帕金森综合征；②静坐不能；③急性肌张力障碍；④迟发性运动障碍。中枢抑制症状（嗜睡、淡漠、无力等）、M受体阻断症状（视物模糊、口干、无汗、便秘、眼压升高（C错）等）和受体阻断症状（鼻塞、血压下降（D错）、自主性低血压及反射性心悸等）。内分泌系统紊乱如乳腺增大（E错）、泌乳、月经停止、抑制儿童生长等。